残气量与肺活量之和等于
A. 深吸气量
B. 肺总量
C. 用力呼气量
D. 功能残气量
E. 补吸气量

正确答案：B。肺总量

解析：残气量（余气量）与肺活量之和等于肺总量（B对）。深吸气量（A错）等于补吸气量（E错）和潮气量之和。用力呼气量（C错）是指一次最大吸气后尽力尽快呼气，在一定时间内所能呼出的气体量。功能残气量（D错）等于补呼气量与余气量之和。